依法从事生产、运输、管理、使用国家管制的麻醉药品、精神药品的人员，违反国家规定，向吸食、注射毒品的人提供国家规定管制的能够使人形成瘾癖的麻醉药品、精神药品，情节严重的，刑法规定处以
A. 3年以上7年以下有期徒刑，并处罚金
B. 由所在单位给予行政处分
C. 3年以下有期徒刑或拘役，并处罚金
D. 公安部门行政拘留并处罚金
E. 单处罚金

正确答案：A。3年以上7年以下有期徒刑，并处罚金

解析：本题考查扰乱市场秩序。《中华人民共和国刑法》第三百五十五条：依法从事生产、运输、管理、使用国家管制的麻醉药品、精神药品的人员，违反国家规定，向吸食、注射毒品的人提供国家规定管制的能够使人形成瘾癖的麻醉药品、精神药品的，处三年以下有期徒刑或者拘役，并处罚金；情节严重的，处三年以上七年以下有期徒刑，并处罚金（A对）。向走私、贩实毒品的犯罪分子或者以牟利为目的，向吸食、注射毒品的人提供国家规定管制的能够使人形成瘾癖的麻醉药品、精神药品的，依照本法第三百四十七条的规定定罪处罚。